用活性炭吸附法净化饮用水，去除效果不明显的物质是
A. 臭味和腐殖质
B. 天然和合成溶解性有机物
C. 总有机碳和总有机卤化物
D. 总有机碳和总三卤甲烷
E. 微生物和溶解性金属

正确答案：E。微生物和溶解性金属

解析：本题考查活性炭吸附法。用活性炭吸附法净化饮用水，去除效果较明显的物质有：色、臭、味、腐殖酸（A对）、微量污染物、天然和合成溶解性有机物（B对）、总有机碳、总有机卤化物（C对）及总三卤甲烷（D对）等。活性炭对微生物和溶解性金属（E错，为本题正确答案）去除效果一般不明显。